丙硫氧嘧啶治疗甲状腺功能亢进时，必须监测的实验室指标是
A. 血肌酐计数
B. 血尿素氮计数
C. 血红蛋白计数
D. 红细胞计数
E. 白细胞计数

正确答案：E。白细胞计数

解析：本题考查丙硫氧嘧啶的使用。丙硫氧嘧啶治疗甲状腺功能亢进时，必须监测的实验室指标是白细胞计数（E对）。丙硫氧嘧啶最严重的不良反应是粒细胞缺乏症，多发生于老年患者或大剂量药物使用者。若用药后出现发热、咽痛或口腔溃疡等现象，应立即停药并进行白细胞计数等相关检查。